最易形成慢性感染的病原体是
A. HIV
B. HBV
C. HAV
D. HSV
E. HPV

正确答案：B。HBV

解析：慢性感染指显性感染或隐性感染后，病毒并未完全清除，仍持续存在于血液或组织中并不断排出体外或经输血，注射而传播给易感者。病程常达数月至数十年，患者症状轻微或无临床症状，如HBV、巨细胞病毒（CMV）、EB病毒等慢性感染。掌握“病毒传播方式、感染类型、致病机制及免疫”知识点。